卫生服务反应性中的“对人的尊重”包括
A. 尊严、自主性和保密性
B. 尊严、及时性和社会支持
C. 社会支持、及时性和保密性
D. 社会支持、自主性和保密性
E. 自主性、保密性和及时性

正确答案：A。尊严、自主性和保密性

解析：反应性测量分为主观性指标如‘尊重人权’和客观性指标如‘以卫生服务对象为中心’两个部分。其中对“人的尊重”包括尊严、自主性和保密性（A对）。及时性和社会支持是以卫生服务对象为中心的内容（BCDE错）。